预防接种
A. 第一级预防
B. 第二级预防
C. 第三级预防
D. 传染病的预防性措施
E. 传染病的防疫性措施

正确答案：A。第一级预防